压缩双电层作用的含义是
A. 水中加入电解质后，其正离子挤入扩散层，进而进入吸附层，使胶体表面电位降低
B. 水中加入电解质后，其负离子直接进入吸附层，使胶体表面电位降低
C. 水中加入电解质后，分子本身成为带电的粒子使胶体表面电位降低
D. 水中加入电解质后，其负离子直接挤入吸附层，中和胶体表面的正电荷
E. 水中加入电解质后，其正离子直接挤入吸附层，中和胶体表面的负电荷

正确答案：A。水中加入电解质后，其正离子挤入扩散层，进而进入吸附层，使胶体表面电位降低

解析：本题考查压缩双电层作用。压缩双电层作用是指水中加入电解质后，其正离子会挤入扩散层而使之变薄，进而进入吸附层，使胶体表面电位降低（A对BCDE错），因而使双电层变薄。